诊断自主性功能亢进性甲状腺腺瘤最佳的甲状腺检查是
A. B超
B. 放射性核素扫描
C. CT
D. 131碘摄取率
E. MRI

正确答案：B。放射性核素扫描

解析：甲状腺放射性核素扫描（B对）即患者摄入一定量的放射性碘元素后，应用γ闪烁照相机使甲状腺显像，根据甲状腺结节摄取核素的多寡，划分为热结节、温结节和冷结节。自主性功能亢进性甲状腺瘤核素摄取功能比一般甲状腺组织强，为热结节，可用于鉴别诊断，既能明确其功能又能明确其结构特点。B超（A错）为诊断甲状腺结节的首选检查（P695），但其仅能确定甲状腺结节的大小、数量、质地等形态学特征，无法明确其功能。CT（C错）以及MRI（E错）亦不能进行功能性判断。¹³¹I摄取率（D错）主要用于区别甲状腺功能亢进型甲亢和非甲状腺功能亢进型甲状腺毒症，前者甲状腺毒症¹³¹I摄取率增高，后者¹³¹I摄取率降低，但不能鉴别甲状腺毒症的具体原因。